心肌梗死后附壁血栓引起的脑血管疾病最常见的是
A. 蛛网膜下腔出血
B. 脑血栓形成
C. 脑栓塞
D. 脑出血
E. 脑动脉炎

正确答案：C。脑栓塞

解析：心肌梗死后的栓塞发生率为1%～6%，见于起病后1～2周，若左心室附璧血栓脱落，可随血液循环运动到脑，从而堵塞脑血管，形成脑栓塞（C对）。脑血栓形成（B错）是由于脑血管自身的狭窄或闭塞，导致脑组织缺血、软化、坏死而产生偏瘫、失语、感觉障碍等一系列中枢神经症状。主要为脑血管自身病变，而不是心肌梗死的并发症。蛛网膜下腔出血（A错）和脑出血（D错）是高血压的常见并发症（P250）。脑动脉炎（E错）是一种因感染、药物或变态反应等因素导致脑动脉管腔狭窄、闭塞、供血区脑组织缺血、梗死引起的，以肢体瘫痪、失语、精神症状为主要表现的脑血管疾病，与心肌梗死关系不大。